女，35岁，发现颈前包块3年，半年来有所增大，无不适症状，既往体健，查体T36.5°C，P80次/分，R18次/分，BP120/80mmHg，甲状腺右叶触及2.5cm×2cm肿物，质硬，边界不清，双肺呼吸音清，未闻及干湿性啰音，心率80次/分，律齐，腹软，无压痛。超声提示甲状腺右叶下段2.1cm×1.9cm实性占位，边缘不规则，内有细小钙化，为患者进行手术治疗的依据是
A. 易继发甲亢
B. 有恶性可能
C. 包块半年内有所增大
D. 易伴发出血
E. 包块大小

正确答案：B。有恶性可能

解析：患者颈前包块，半年来有所增大，甲状腺右叶触及2.5cm×2cm肿物，质硬，边界不清，超声提示甲状腺右叶下段2.1cm×1.9cm实性占位，边缘不规则，内有细小钙化，因此怀疑甲状腺癌。因此为该患者进行手术治疗的依据是有恶性可能（B对）。